关于硬胶囊剂质量要求的叙述，不正确的是
A. 外观应整洁，不得有粘结、变形或破裂等现象
B. 内容物应干燥、松散、混合均匀
C. 水分含量不得超过9.0%
D. 应在60min内崩解
E. 每粒装量与标示量比较，应在±10%以内

正确答案：D。应在60min内崩解